艾滋病患者中，最常见的恶性肿瘤是
A. 霍奇金淋巴瘤
B. 非霍奇金淋巴瘤
C. 卡波氏肉瘤
D. 子宫颈癌
E. 阴茎癌

正确答案：C。卡波氏肉瘤

解析：艾滋病患者因免疫功能低下，常伴发多种恶性肿瘤，以Kaposi肉瘤（卡波氏肉瘤）（C对）最为常见。